加强十二经脉与头面联系的是
A. 皮部
B. 奇经
C. 经别
D. 经筋
E. 别络

正确答案：C。经别

解析：十二经别的生理功能：①加强十二经脉表里两经在体内的联系。②加强体表与体内、四肢与躯干的向心性联系。③加强足三阴、足三阳经脉与心脏的联系。④加强了十二经脉和头面部的联系（C对）。⑤扩大十二经脉的主治范围。经筋的功能（D错）：①约束骨骼、主司关节运动。②满布于躯体和四肢的浅部，延伸十二经脉在体表的循行，加强经络系统对肢体的连缀作用。③深入体内，对脏腑与周身各部分组织起到一定的保护作用。皮部位于人体最浅表部位，与外界直接接触，并依赖布散于体表的卫气，发挥其抗御外邪的作用（A错）。别络的生理功能（E错）：①加强十二经脉表里两经在体表的联系。②加强人体前、后、侧面联系，统率其他络脉。③渗灌气血以濡养全身。奇经八脉的生理功能（B错）：①密切十二经脉的联系。②调节十二经脉气血。③与某些脏腑关系密切。